与传染病流行过程关系不大的因素是
A. 病原体的传染性和致病性
B. 传播途径
C. 个人的免疫力
D. 人群易感性
E. 环境卫生状况

正确答案：C。个人的免疫力